治疗肺炎风热犯肺证，应首选
A. 银翘散
B. 桑菊饮
C. 千金苇茎汤
D. 竹叶石膏汤
E. 泻白散

正确答案：A。银翘散

解析：肺炎风热犯肺证，治宜疏风清热，宣肺止咳，首选疏风清热，宣肺止咳的银翘散（A对）。桑菊饮（B错）可疏风清热，宣肺止咳，用于治疗风温初起。千金苇茎汤（C错）可清热解毒，化瘀消痈，用于肺痈的成痈期。竹叶石膏汤（D错）可清热养阴，益气补肺，治疗阴虚肺热证。泻白散（E错）可清泻肺热，治疗肺胃热盛证。